携带缺陷基因BRCA–1者易患的疾病是
A. 白血病
B. 结肠癌
C. 甲状腺癌
D. 肺癌
E. 乳腺癌

正确答案：E。乳腺癌

解析：携带缺陷基因BRCA-1者易患具有遗传倾向的乳腺癌（E对）。白血病（A错）、结肠癌（B错）、甲状腺癌（C错）和肺癌（D错）均与BRCA-1基因无关。